女，31岁。产后5个月，哺乳期，阴道不规则流血半月余，胸闷咳嗽10天。妇科检查：宫颈前唇有一个2cm×1cm×1cm的紫蓝色结节，子宫如50天妊娠大小，质软，无压痛。双侧附件区各触及囊性包块，均约6cm×5cm×5cm大小，表面光滑。胸X线片示双肺下部多发棉絮状阴影。首选的治疗方案是
A. 卵巢肿瘤切除术
B. 放射治疗
C. 消宫术
D. 化学治疗
E. 子宫切除

正确答案：D。化学治疗

解析：中年女性患者，无葡萄胎妊娠病史，存在阴道不规则流血，胸闷咳嗽（肺转移表现）。妇科检查：宫颈前唇有一个紫蓝色结节（病灶侵及子宫浆膜层）。胸X线片示双肺下部多发棉絮状阴影（肺转移）。综合患者的症状、体征和辅助检查，初步诊断为绒癌。首选的治疗方案是化学治疗（D对）。卵巢肿瘤切除术（A错）主要用于卵巢肿瘤的治疗。放射治疗（B错）应用较少，主要用于肝、脑转移和肺部耐药病灶的治疗。子宫切除（E错）主要用于化学治疗的辅助治疗。消宫术（C错）主要用于葡萄胎的治疗，且用于化学治疗的辅助治疗。